患者，女，27岁。G₂P₁，停经60天，阴道流血10余天。尿妊娠试验阳性。首选的检查
A. 宫腔镜检查
B. 诊断性刮宫
C. B型超声检查
D. CT检查
E. MRI检查

正确答案：C。B型超声检查

解析：患者，女，27岁。G₂P₁（孕2产1），尿妊娠试验阳性（考虑妊娠），停经60天，阴道流血10余天（停经后阴道流血为葡萄胎最常见的症状），考虑为葡萄胎，诊断葡萄胎可靠和敏感的辅助检查是B型超声（C对）。